目前推荐的抑制胃酸分泌药物的给药方法是
A. 早晨1次顿服
B. 每12h服1次
C. 每8h服1次
D. 晚上1次顿服
E. 午饭后1次顿服

正确答案：D。晚上1次顿服

解析：本题考查抑制胃酸分泌药物的给药方法。目前推荐的抑制胃酸分泌药物的给药方法是晚上1次顿服（D对）。抑制胃酸分泌药通常包括组胺H₂受体阻断剂和质子泵抑制剂。组胺H₂受体阻断剂有口服及静脉两种给药方式。口服吸收完全，l～2h达峰值，抑制夜间酸分泌作用较强。同时，因为胃酸分泌最旺盛的时间是晚上11点到凌晨5点，所以给药方法为：晚上服用。